急性坏死性龈炎病变部位数量增加最多的厌氧微生物是
A. 粘性放线菌与螺旋体
B. 伴放线杆菌
C. 梭形杆菌与螺旋体
D. 梭形杆菌与牙龈卟啉单孢菌
E. 牙龈卟啉单孢菌

正确答案：C。梭形杆菌与螺旋体

解析：本题考查急性坏死性溃疡性龈炎。急性坏死性龈炎病变部位数量增加最多的厌氧微生物是梭形杆菌与螺旋体（C对）。粘性放线菌（A错）与牙龈炎的发生有关。伴放线杆菌（B错）与局限性侵袭性牙周炎有关。牙龈卟啉单孢菌（DE错）与慢性牙周炎有关。